引起分层的原因是
A. Zeta电位降低
B. 分散相与连续相存在密度差
C. 微生物及光、热、空气等的作用
D. 乳化剂失去乳化作用
E. 乳化剂类型改变

正确答案：B。分散相与连续相存在密度差

解析：本题考查乳剂。乳剂的分层系指乳剂放置后出现分散相粒子上浮或下沉的现象，又称乳析。分层主要是由于分散相和分散介质之间的密度差（B对）造成的。Zeta电位降低（A错）是引起絮凝的原因。微生物及光、热、空气等的作用（C错）是引起酸败的原因。乳化剂失去乳化作用（D错）是引起乳剂破裂的原因。乳化剂类型改变（E错）是引起转相的原因。